石榴树皮的形状多为
A. 板片状
B. 单卷状
C. 筒状
D. 双卷筒状
E. 反曲状

正确答案：E。反曲状